以下关于粘接剂的说法哪项是错误的
A. 分树脂类和无机盐类
B. 无机盐类可溶于唾液
C. 其被膜越厚越好
D. 树脂类的粘接力大于无机盐类
E. 对修复体的边缘封闭可起重要作用

正确答案：C。其被膜越厚越好

解析：本题考查粘接剂。被膜（薄膜）不是越厚越好（C错，为本题的正确答案），过后会影响粘接效果，不利于修复体就位和固位。粘接剂分为树脂类和无机盐类（A对），树脂类可用来粘固各种固定修复体和树脂充填体，无机盐类也可用来粘固各种固定修复体，还可用来进行垫底、洞衬、充填修复和根充，无机盐类粘接剂也称水门汀，是溶于唾液的（B对）。树脂类的粘接力大于无机盐类（D对），因为树脂类通过酸蚀预处理提高对牙齿的粘接强度，无机盐类只是单纯的机械粘接。使用粘接剂充分占据修复体和牙体组织之间的空隙，对修复体的边缘封闭可起重要作用（E对）。